治疗流行性脑脊髓膜炎首选的药物是
A. 环丙沙星
B. 利福平
C. 多西环素
D. 磺胺嘧啶
E. 庆大霉素

正确答案：D。磺胺嘧啶